患者男，65岁，既往有痛风、前列腺增生史，近期因头昏、心悸等症状就诊，检查血压为165/98mmHg，需抗高血压药物进行治疗，宜推荐使用的有
A. 福辛普利
B. 氢氯噻嗪
C. 氨氯地平
D. 特拉唑嗪
E. 吲达帕胺

正确答案：A、C、D。福辛普利；氨氯地平；特拉唑嗪

解析：本题考查降压药。患者男，65岁，既往有痛风、前列腺增生史，近期因头昏、心悸等症状就诊，检查血压为165/98mmHg，需抗高血压药物进行治疗，宜推荐使用的有福辛普利（A对）、氨氯地平（C对）、特拉唑嗪（D对）。福辛普利为血管紧张素转化酶抑制剂。氨氯地平为钙通道阻滞药。特拉唑嗪为α受体阻断药。氢氯噻嗪（B错）和吲达帕胺（E错）都是属于噻嗪类利尿剂，痛风患者禁用。